根据现行GSP的规定，药品批发企业负责人中主管质量管理工作的人员应具有
A. 药学或相关专业的学历，或者具有药学专业的技术职称
B. 执业药师
C. 相应的药学专业技术职称
D. 药师以上专业技术职称
E. 主管药师以上专业技术职称

正确答案：B。执业药师

解析：本题考查药品批发企业经营和质量管理人员的资质要求。根据现行GSP的规定药品批发企业负责人中主管质量管理工作的人员应具有执业药师（B对）资格和三年以上药品经营质量管理工作经历，能独立解决经营过程中的质量问题。